供应枕叶的动脉主要来自
A. 小脑上动脉
B. 后交通动脉
C. 大脑前动脉
D. 大脑中动脉
E. 大脑后动脉

正确答案：E。大脑后动脉

解析：供应枕叶的动脉主要来自大脑后动脉（E对）。小脑上动脉（A错）供应小脑上部。后交通动脉（B错）为颈内动脉系与椎-基底动脉系的吻合支。大脑前动脉（C错）的皮质支供应顶枕沟以前的半球内侧面、额叶底面的一部分和额、顶两叶上外侧面的上部。大脑中动脉（D错）的皮质支供应大脑半球外侧面大部分和岛叶。